治疗耳鸣实证，应选用以上哪组腧穴为主
A. 合谷、神门、翳风
B. 百会、耳门、风池
C. 太溪、照海、听宫
D. 翳风、听会、中渚
E. 太冲、耳门、听宫

正确答案：D。翳风、听会、中渚

解析：耳鸣实证多由外感风邪或肝胆郁火循经上扰清窍。治宜疏风泻火，通络开窍。以局部穴及手足少阳经穴为主。主穴选用听会、翳风、中渚、侠溪。手足少阳之脉均绕行于耳之前后并入耳中，听会属足少阳经，翳风属手少阳经，两穴均居耳周，可疏导少阳经气，主治耳疾；循经远取侠溪、中渚，可通上达下，疏导少阳经气，宣通耳窍（D对）。